饮水氟化的防龋效果应该是
A. 前牙优于后牙
B. 后牙优于前牙
C. 恒牙优于乳牙
D. 乳牙优于恒牙
E. 恒牙和乳牙均好

正确答案：C。恒牙优于乳牙

解析：饮水氟化的防龋效果恒牙优于乳牙，可能与胎盘和乳腺的部分屏障作用和乳牙牙冠与组织液接触时间较短有关。掌握“氟的全身及局部应用”知识点。